上前牙3/4冠邻沟的方向为
A. 与牙长轴平行
B. 与唇面切2/3平行
C. 与唇面切1/3平行
D. 与唇面龈1/3平行
E. 与舌隆突平行

正确答案：B。与唇面切2/3平行

解析：本题考查前牙3/4冠邻沟的方向。上前牙3/4冠邻沟的制备方向与唇面切2/3（B对）及舌隆突下的轴壁（E错）平行，以保持和部分冠的就位道一致，否则无法就位。在后牙与牙长轴平行（A错）以保持和就位道一致。与唇面切1/3平行（C错）、与唇面龈1/3平行（D错）、与舌隆突平行（E错）都无法与就位道一致，会使就位困难。